考核抗结核治疗效果的主要指标是
A. 查痰抗酸杆菌
B. 胸部X线检查
C. 胸部CT
D. 痰菌检查
E. 血常规

正确答案：A。查痰抗酸杆菌

解析：本题考查考核抗结核治疗效果的主要指标。考核抗结核治疗效果的主要指标是查痰抗酸杆菌（A对BCDE错），痰结核菌检查是发现传染源的重要手段，也是在资源贫乏地区结核病诊断的基本方法，具有较高的特异性。为了获得满足诊断要求的痰标本除了收集病人就诊时的即时痰外，还应要求病人次日带“清晨痰”和“夜间痰”进行检查。医务人员应告诉病人留取合格痰标本的方法，保证病人提供的痰标本为从肺深部咳出的黏性或脓性痰。